某男，75岁，1年来，咳嗽，心悸气短，骨蒸潮热，腰痛耳鸣，遗精盗汗，大便干燥。证属阴虚气弱，虚劳咳嗽。治当滋阴益气，固本培元，宜选用的成药是
A. 十全大补丸
B. 人参归脾丸
C. 人参固本丸
D. 桂附地黄丸
E. 七宝美髯丹

正确答案：C。人参固本丸

解析：本题考查的是人参固本丸的功能。1年来，咳嗽，心悸气短，骨蒸潮热，腰痛耳鸣，遗精盗汗，大便干燥。证属阴虚气弱，虚劳咳嗽。治当滋阴益气，固本培元，宜选用的成药是人参固本丸（C对）。人参固本丸：【功能】滋阴益气，固本培元。十全大补丸（A错）：【功能】温补气血。人参归脾丸（B错）：【功能】益气补血，健脾宁心。桂附地黄丸（D错）：【功能】温补肾阳。七宝美髯丸（E错）：【功能】滋补肝肾。